超声洁治术禁用于
A. 安装心脏起搏器的患者和传染病人
B. 高血压患者
C. 糖尿病患者
D. 孕妇
E. 老年患者

正确答案：A。安装心脏起搏器的患者和传染病人

解析：本题考查超声洁治术的禁忌证。超声洁治术禁用于安装心脏起搏器的患者和传染病人（A对）。超生洁治术禁用于置有心脏起搏器的患者，以免因电磁辐射的干扰造成眩晕及心率紊乱等症状；对于有肝炎、肺结核、艾滋病等传染性疾病患者也不宜使用超生洁牙，以免血液和病原菌随喷雾而污染诊室环境。高血压患者血压控制后可以进行洁治术（B错）；糖尿病患者（C错）及孕妇（D错）可以进行洁治术，但动作应轻柔；老年患者经口腔卫生宣教后可进行洁治术，给患者以安慰，避免紧张情绪（E错）。